氯己定含漱剂作为牙周病局部用药的浓度范围
A. 0.1%～1.0%
B. 0.1%～0.2%
C. 0.11%～0.1%
D. 0.12%～0.2%
E. 1%～1.5%

正确答案：D。0.12%～0.2%

解析：目前临床上用的是0.12%～0.2%的氯己定含漱液。掌握“慢性牙周炎的治疗原则、程序及方法”知识点。